炮制后多入丸散用的毒性中药
A. 斑蝥
B. 天仙子
C. 生马钱子
D. 生甘遂
E. 生川乌

正确答案：A、C、D。斑蝥；生马钱子；生甘遂

解析：本题考查的是毒性中药的用法用量。炮制后多入丸散用的毒性中药斑蝥（A对）、生马钱子（C对）与生甘遂（D对）。斑蝥的用法用量：内服，0.03～0.06g，多炮制后入丸散用。外用适量，研末或浸酒醋，或制油膏涂敷患处。注意事项：内服慎用，孕妇禁用，不宜大面积外用。生马钱子的用法用量：内服，0.3～0.6g，炮制后入丸散。注意事项：孕妇禁用；不宜生用；不宜多服久服；运动员慎用；有毒成分能经皮肤吸收，外用不宜大面积涂敷。生甘遂的用法用量：内服，0.5～1.5g，炮制后多入丸散用。外用适量，生用。注意事项：孕妇禁用，不宜与甘草同用。生天仙子（B错）的用法用量：内服，0.06～0.6g。注意事项：心脏病、心动过速、青光眼患者及孕妇禁用。生川乌（E错）的用法用量：一般炮制后用。注意事项：生品内服宜慎；孕妇禁用；不宜与半夏、瓜蒌、瓜蒌子、瓜蒌皮、天花粉、川贝母、浙贝母、平贝母、伊贝母、湖北贝母、白蔹、白及同用。